可以导致血胆固醇增高的药品是
A. 氟伐他汀
B. 氯氮平
C. 非诺贝特
D. 二甲双胍
E. 吗啡

正确答案：B。氯氮平

解析：本题考查引起胆固醇增高的因素。可以导致血胆固醇增高的药品是氯氮平（B对）。可以导致血胆固醇增高的药品有口服避孕药、环孢素、肾上腺糖皮质激素、抗精神病药（如氯氮平）、阿司匹林等。氟伐他汀（A错）、非诺贝特（C错）可降低胆固醇。二甲双胍（D错）为口服降血糖药。吗啡（E错）为镇痛药。